按诊疗同意制度，无法取得患者意见又无家属或者关系人在场，或者遇到其他特殊情况时，处理措施是
A. 可以由经治医生决定施行
B. 可以由经治医生与其他医生商量后决定施行
C. 经治医师提出处置方案后，由无利害关系的人二人以上在场见证情况下施行
D. 经治医师提出处置方案，取得医疗机构负责人批准后实施
E. 经治医师决定，其他医护人员在场见证情况下施行

正确答案：D。经治医师提出处置方案，取得医疗机构负责人批准后实施

解析：在施行手术、特殊检查或者特殊治疗时，如无法取得患者意见又无家属或者关系人在场，或者遇到其他特殊情况时，经治医师应当提出医疗处置方案，在取得医疗机构负责人或者被授权负责人的批准后实施。掌握“医疗机构概述及机构执业”知识点。